卵巢黏液性囊腺瘤病理特点，错误的是
A. 多房居多
B. 多为双侧
C. 体积多较大
D. 囊内充满胶冻状物
E. 囊内很少有乳头生长

正确答案：B。多为双侧

解析：卵巢黏液性囊腺瘤病理特点为多为单侧（B错，为本题正确答案），圆形或卵圆形，体积多较大（C对），表面光滑，灰白色。切面常为多房（A对），囊内充满胶冻状物（D对），含黏蛋白和糖蛋白，囊内很少有乳头生长（E对）。